在反映人群中慢性病流行水平和疾病负担的全球和国家报告中，最不常见的频率指标是
A. 死亡率
B. 发病率
C. 患病率
D. DALY
E. YLD

正确答案：B。发病率